增加直肠栓剂发挥全身作用的条件是
A. 粪便的存在有利于药物吸收
B. 插入肛门2cm处有利于药物吸收
C. 油水分配系数大释放药物快有利于吸收
D. 油性基质的栓剂中加入HLB值大于11的表面活性剂能促使药物从基质向水性介质扩散有利于药物吸收
E. 一般水溶性大的药物有利于药物吸收

正确答案：B、D、E。插入肛门2cm处有利于药物吸收；油性基质的栓剂中加入HLB值大于11的表面活性剂能促使药物从基质向水性介质扩散有利于药物吸收；一般水溶性大的药物有利于药物吸收

解析：本题考查栓剂。栓剂直肠给药时，插入肛门2cm处，药物吸收可绕过肝脏直接进入体循环，有利于药物吸收（B对）；在基质中加入表面活性剂，有利于增加药物的亲水性，从而增加药物的穿透性，能促进药物向水性介质扩散（D对）；一般水溶性大的药物易溶于体液，增加了药物与吸收部位的接触面积，从而增加吸收（E对）；粪便的存在会影响药物的吸收（A错）；脂溶性药物油水分配系数大，释放药物慢，不利于吸收（C错）。